小儿感冒主要的病原体是
A. 病毒
B. 肺炎支原体
C. 衣原体
D. 葡萄球菌
E. 立克次体

正确答案：A。病毒

解析：小儿感冒主要的病原体是病毒。肺炎支原体也可引起上呼吸道感染。细菌感染多为继发，溶血性链球菌、肺炎球菌、嗜血流感杆菌及葡萄球菌等多见（A对）。